患者老年，发热，咳嗽1周。查体：体温38℃，血压80/50mmHg（10.6/6.7kPa），左肺下可闻及湿啰音，心音减弱，心率快。下列哪项处理是错误的
A. 使用血管活性药物
B. 予以吸氧
C. 药物降温
D. 补充血容量
E. 纠正代谢性酸中毒

正确答案：C。药物降温

解析：患者老年，发热，咳嗽1周。查体：体温38℃，血压80/50mmHg（10.6/6.7kPa），左肺下可闻及湿啰音，心音减弱，心率快，可以诊断为心力衰竭，治疗需要使用血管活性药物（A对）、予以吸氧（B对）、补充血容量（D对）、纠正代谢性酸中毒（E对）。药物降温（C错，为本题正确答案）会掩盖病情，不是合适的处理方式。